仙灵骨葆胶囊的功能是
A. 强筋骨，祛风湿，通经络
B. 活血通络，散风止痛
C. 滋补肝肾，活血通络，强筋壮骨
D. 清热祛湿，活血通络定痛
E. 壮腰健肾，祛风活络

正确答案：C。滋补肝肾，活血通络，强筋壮骨

解析：本题考查的是仙灵骨葆胶囊的功能。仙灵骨葆胶囊的功能是滋补肝肾，活血通络，强筋壮骨（C对）。仙灵骨葆胶囊：【功能】滋补肝肾，活血通络，强筋壮骨。尪痹颗粒：【功能】补肝肾，强筋骨，祛风湿，通经络（A错）。颈复康颗粒：【功能】活血通络，散风止痛（B错）。痛风定胶囊：【功能】清热祛湿，活血通络定痛（D错）。壮腰健肾丸：【功能】壮腰健肾，祛风活络（E错）。